颈外静脉
A. 由颞浅静脉和上颌静脉汇合成
B. 有瓣膜可以防止血液逆流
C. 引流颈外动脉分布区域的静脉血
D. 注入锁骨下静脉
E. 注入颈总静脉

正确答案：D。注入锁骨下静脉

解析：颈外静脉由下颌后静脉的后支、耳后静脉和枕静脉（A错）在下颌角处汇合而成。颈内静脉末端有一对瓣膜，但不能（B错）防止血液逆流。颈外静脉主要收集头皮和面部（C错）的静脉血，不只是引流颈外动脉分布区域的静脉血。颈外静脉注入锁骨下静脉或静脉角（D对）。